表明食品被粪便近期污染的指示菌属于
A. 埃希氏菌属
B. 柠檬酸杆菌属
C. 肠杆菌属
D. 克雷伯菌属
E. 黄杆菌属

正确答案：A。埃希氏菌属

解析：本题考查食品被粪便近期污染的指示菌。埃希氏菌属（A对BCDE错）为典型大肠杆菌，在食品中检出典型的大肠杆菌说明被粪便近期污染。